无排卵性功能失调性子宫出血子宫内膜的表现是
A. 月经5～6日刮宫子宫内膜呈增生和分泌并存
B. 月经5～6日刮宫子宫内膜呈分泌型
C. 经前诊断性刮宫子宫内膜呈增生型
D. 经前诊断性刮宫子宫内膜呈蜕膜反应
E. 经前诊断性刮宫子宫内膜呈分泌不良

正确答案：C。经前诊断性刮宫子宫内膜呈增生型

解析：无排卵性功血患者的子宫内膜受雌激素持续作用而无孕激素拮抗，可发生不同程度的增生性改变，少数可呈萎缩性改变，故经前诊断性刮宫子宫内膜呈增生型（C对）。经前诊断性刮宫子宫内膜呈蜕膜反应（D错）为早期妊娠的表现。经前诊断性刮宫子宫内膜呈分泌不良（P350）（E错）为黄体功能不全的表现。月经5～6天刮宫子宫内膜呈增殖期与分泌期并存（P351）（A错）、月经5～6日刮宫子宫内膜呈分泌型（P351）（B错）为子宫内膜不规则脱落的表现。